某研究者欲利用2000年的人口出生和死亡登记资料评价某地居民健康状况，宜选择的指标
A. 生存率
B. 死亡率
C. 预期寿命
D. 出生率
E. 病死率

正确答案：C。预期寿命